为研究胃溃疡病与饮酒的关系，某大夫调查了100名胃溃疡病人的饮酒史和100名胃炎病人的饮酒史，这是属于
A. 群组研究
B. 病例对照研究
C. 实验流行病学研究
D. 现况研究

正确答案：B。病例对照研究

解析：本题考查病例对照研究的概念。病例对照研究（B对ACDE错）是以当前已经确诊的患有某特定疾病的一组病人作为病例组，以不患有该病但具有可比性的一组个体作为对照组，通过询间、实验室检查或复查病史，搜集研究对象既往对各种可能的危险因素的暴露史，测量并采用统计学检验，比较病例组与对照组各因素暴露比例的差异是否具有统计学意义，然后评估各种偏倚对研究结果的影响，并借助病因推断技术，判断某个或某些暴露因素是否为疾病的危险因素，从而达到探索和检验病因假说的目的。